习惯性流产是指连续自然流产
A. 1次及以上
B. 2次及以上
C. 3次及以上
D. 4次及以上
E. 5次及以上

正确答案：C。3次及以上